下列产褥期的临床表现，正确的是
A. 产后第一日，子宫底稍下降
B. 产后初期，产妇脉搏增快
C. 产后1～2天可发生“泌乳热”
D. 产后宫缩痛多见于经产妇
E. 恶露通常持续1～2周

正确答案：D。产后宫缩痛多见于经产妇

解析：胎盘娩出后，子宫圆而硬，宫底在脐下一指，产后第1日宫底稍上升至脐平（A错），以后每日下降1～2cm，在产后10日子宫下降入骨盆腔内；产后脉搏略缓慢（B错），每分钟约60～70次，产后1周恢复正常；产后3～4天乳房血管、淋巴管极度充盈，乳房胀大，可有37.8～39℃的发热，称为泌乳热（C错），持续4～16个小时，体温即下降，不属于病态；产褥期由于子宫阵发性收缩引起下腹部剧烈疼痛称产后宫缩痛，产后1～2日出现，持续2～3天疼痛自然消失，中医称之为儿枕痛，多见于经产妇（D对）；正常恶露有血腥味，但无臭味，持续4～6周，总量250～500mL，若子宫复旧不全或宫腔内残留胎盘、多量胎膜或合并感染时，恶露增多，血性恶露持续时间延长并有臭味（E错）。